对于右冠状动脉的描述何者正确
A. 进入前室间沟
B. 汇入冠状窦
C. 发出后室间支、窦房结支、房室结支等
D. 分为旋支和前室间支
E. 营养左心房

正确答案：C。发出后室间支、窦房结支、房室结支等

解析：右冠状动脉进入冠状沟（A错）。发出后室间支、窦房结支、房室结支等分支（C对）。分为后室间支（D错）和右旋支。